一男性，某省厅干部，平时不嗜烟酒，生活规律；但性情急躁，易激动，工作认真，争强好胜，雄心勃勃。1年前单位减员时调人某厂工作，常因小事上火，发脾气。3日前因心绞痛人院，诊断为冠心病。病前病人的人格类型是
A. A型
B. B型
C. C型
D. A、B混合型
E. B、C混合型

正确答案：A。A型